心力储备是指
A. 静息状态下心脏的收缩能力
B. 运动状态下心脏的收缩能力
C. 每搏输出量的多少
D. 心输出量的多少
E. 随着机体功能代谢需要心输出量增长的能力

正确答案：E。随着机体功能代谢需要心输出量增长的能力

解析：当机体功能代谢增加时，心输出量随之增长（E对）以供应足够的氧气和营养物质，心脏的这种能力称为心力储备。